正确描述外耳道的是
A. 外侧1／3为骨性部，内侧2／3为软骨部
B. 外侧1／3为软骨部，内侧2／3为骨性部
C. 外侧2／3为骨性部，内侧1／3为软骨部
D. 外侧2／3为软骨部，内侧1／3为骨性部
E. 以上都不对

正确答案：B。外侧1／3为软骨部，内侧2／3为骨性部

解析：外耳道的外1/3 为软骨部，与耳郭的软骨相延续；内 2/3为骨性部（B对）。